进入疟区时，作为病因性预防的常规用药是
A. 伯氨喹
B. 氯喹
C. 乙胺嘧啶
D. 周效磺胺
E. 奎宁

正确答案：C。乙胺嘧啶

解析：乙胺嘧啶为二氢叶酸还原酶抑制药，阻止二氢叶酸转变为四氢叶酸，阻碍核酸的合成，从而抑制疟原虫的增殖，对已发育成熟的裂殖体则无效，故控制临床症状起效缓慢，常用于病因性预防。掌握“氯喹、青蒿素、伯氨喹及乙胺嘧啶”知识点。